下列属于青少年健康监测形态指标的是
A. 立定跳远
B. 上臂围
C. 肺活量
D. 50米跑
E. 引体向上

正确答案：B。上臂围